基因诊断与治疗中遵循的伦理原则中不包括
A. 坚持人类尊严与平等原则
B. 坚持知情同意原则
C. 坚持医学目的原则
D. 坚持唯一性原则
E. 坚持科学性原则

正确答案：D。坚持唯一性原则

解析：基因诊断与基因治疗中提出以下伦理原则供参考：坚持人类尊严与平等原则；坚持知情同意原则；坚持科学性原则；坚持医学目的原则。掌握“人类胚胎干细胞及基因诊疗的伦理”知识点。